设计半固定桥的主要优点是
A. 应力缓冲
B. 以便获得共同的就位道
C. 美观
D. 制作方便
E. 价格便宜

正确答案：B。以便获得共同的就位道

解析：本题考查设计半固定桥的优点。设计半固定桥的主要优点是以便获得共同的就位道（B对）。半固定桥又称为应力中断式固定桥，桥体两端都有固位体，其一端桥体与固位体之间为固定连接体，另一端为非固定相连，多用于牙间隔缺失作复合桥时中间基牙远中部分；或当某些基牙倾斜度大时，双端固定桥修复，难以取得共同就位道时，这时可将两个基牙的就位道分别设计，在一个固位体上设计的栓道与另一个基牙预备体的就位道一致，从而避免牙体组织切割过多时露髓。